牙拔除术时，患有下列疾病时患者需要在拔牙前后给予抗生素，除外
A. 糖尿病
B. 恶性肿瘤
C. 先天性心脏病
D. 慢性肝炎
E. 甲状腺功能亢进

正确答案：D。慢性肝炎

解析：本题考查牙拔除的适应证与禁忌证。牙拔除术时，患有慢性肝炎（D错，为本题正确答案）时患者不需要在拔牙前后给予抗生素。慢性肝炎肝功能有明显损害者，会导致术后出血。肝炎病员需拔牙时应作凝血酶原和出、凝血时间检查，术中还应加用止血药物。对肝炎病员，特别是乙型肝炎病员术中应注意防止医源性交叉感染。